某砂轮工于冬季因右手手麻、手痛、夜间疼痛加剧、影响睡眠，便赴医院诊治。上题病例若怀疑为局部振动病，其处理原则是
A. 继续做砂轮工，服用活血通络中药
B. 继续做砂轮工，每年复查一次
C. 调离接触振动工作，每年复查一次
D. 调离接触振动工作，做运动疗法
E. 病例不详，应先判断是轻度或重度局部振动病

正确答案：E。病例不详，应先判断是轻度或重度局部振动病

解析：本题考查局部振动病的处理原则。局部振动病又称手臂振动病，当确诊为局部振动病时，不同症状也可导致不同的处理方式。轻度局部振动病要调离接触手传振动的作业，进行适当治疗，并根据情况安排其他工作。中度局部振动病和重度局部振动病必须调离振动作业，积极进行治疗。题中工人怀疑为手臂振动病，应进行进一步确诊，判断疾病分级（E对ABCD错），根据疾病的轻中重度进行不同的处置。